社会医学的发源地是
A. 德国
B. 意大利
C. 法国
D. 阿拉伯
E. 美国

正确答案：A。德国

解析：本题考查社会医学的发源地。社会医学的发源地是德国（A对BCDE错）。